某女性患者，7岁，1︱外伤冠折、切角缺损，即刻来院就诊。口腔检查：穿髓孔大、探痛（++），叩痛（±）。治疗首选活髓切断术，进行这种治疗成功的关键是保持操作无菌。若治疗成功、家长要求修复缺损的牙冠应
A. 局麻备牙、全冠修复
B. 桩冠修复
C. 打固位钉、复合树脂充填
D. 切角嵌体
E. 解释病情、待患儿成年后再作修复

正确答案：E。解释病情、待患儿成年后再作修复

解析：本题考查修复缺损的治疗。为了达到美观要求，可以制作临时冠，并向家长解释病情、待患儿成年后再作修复（E对）。此患者年龄尚小，处于混合牙列期，颌面部处于发育状态，且该牙齿尚未完全萌出，龈缘位置以及邻接关系尚不稳定，不适合进行永久性的缺损修复，如全冠（A错）、桩冠（B错）、嵌体（D错）、打固位钉复合树脂充填（C错）等。